由果到因的研究方法是
A. 现况调查
B. 队列调查
C. 病例对照调查
D. 临床实验
E. 社区实验

正确答案：C。病例对照调查

解析：本题考查病例对照研究的特点。病例对照研究（C对ABDE错）的基本特点为：1.观察性研究；2.研究对象分为病例组和对照组；3.由果溯因；4.因果联系的论证强度较弱。